患儿，9个月。烦躁不安，易激惹，偶尔呕吐，大便稀，2-3次/日，查体：嗜睡，前囟稍紧张，颈抵抗可疑，心肺腹无异常，布氏征（+），巴氏征（+），最有鉴别诊断意义的检查是
A. 结核菌素试验
B. X线胸片
C. 大便常规
D. 脑电图检查
E. 脑脊液检查

正确答案：E。脑脊液检查

解析：结核菌素试验，简称PPD皮肤试验，是判断体内有无感染结核菌的一种试验方法，也是诊断肺结核的一种辅助性的检查（A错）。化脑患儿当疑有颅内局限性脓肿、硬膜下积液或脑积水时可进行头颅CT或MRI检查（B错）。大便常规无异常（C错）。脑电图检查异常则表示颅内炎症和脑病为病毒性脑炎（D错）。化脓性脑膜炎脑脊液外观浑浊，早期确认致病菌对明确诊断和指导治疗均有重要意义。因此在做脑脊液常规的同时必须涂片及培养。脑脊液涂片找菌是早期明确致病菌的重要方法（E对）。